某男，26岁。患鼻渊。症见鼻塞，涕黄稠而量多，嗅觉差，伴头痛，发热，汗出，胸闷，咳嗽，痰多。证属风热蕴肺，治宜选用的中成药是
A. 鼻炎片
B. 藿胆片
C. 青果片
D. 铁笛丸
E. 清咽丸

正确答案：A。鼻炎片

解析：本题考查的是鼻渊的辨证论治。患鼻渊。症见鼻塞，涕黄稠而量多，嗅觉差，伴头痛，发热，汗出，胸闷，咳嗽，痰多。证属风热蕴肺，治宜选用的中成药是鼻炎片（A对）。鼻渊风热蕴肺证【症状】鼻塞，涕黄稠而量多，嗅觉差，鼻黏膜红肿，可伴头痛，发热，汗出，胸闷，咳嗽，痰多。舌红，苔黄，脉浮数。【中成药应用】鼻炎康片、辛夷鼻炎丸、鼻炎片、鼻窦炎口服液。对虚火上炎引起的咽喉干燥微痛则应选用玄麦甘桔颗粒、铁笛丸（D错）等。六神丸、清咽丸（E错）等可治疗实热引起的咽喉肿痛，而风热外袭引起的咽喉疼痛应选用复方鱼腥草片、金嗓开音丸等。